河豚毒素首先作用于
A. 运动神经
B. 感觉神经
C. 呼吸中枢
D. 肝
E. 肾

正确答案：B。感觉神经